骨整合是指有序的活体骨和与负重的种植体之间直接的结构和功能的连接，光学显微镜观察骨与种植体之间不存在的结构是
A. 牙槽骨与牙根之间的牙周膜
B. 牙骨质及其插入的纤维
C. 结缔组织
D. 牙周膜纤维
E. 以上均不存在

正确答案：E。以上均不存在

解析：骨整合是指有序的活体骨和与负重的种植体之间直接的结构和功能的连接，光学显微镜下可见骨与种植体紧密接触，缺乏正常的牙槽骨与牙根之间的牙周膜、牙骨质及其插入的纤维。掌握“种植体周围组织”知识点。